患者，女，26岁。因心悸、手颤、易饥饿、烦躁易怒前来就诊，实验室检查游离甲状腺素（FT₃，FT₄）增高、促甲状腺素（TSH）降低，诊断为甲状腺功能亢进症。医师处方给予抗甲状腺药治疗。临床可选用的起效快，代谢慢，维持时间较长的抗甲状腺药是
A. 卡比马唑
B. 丙硫氧嘧啶
C. 甲巯咪唑
D. 碳酸锂
E. 复方碘溶液

正确答案：C。甲巯咪唑

解析：本题考查甲巯咪唑。临床可选用的起效快，代谢慢，维持时间较长的抗甲状腺药是甲巯咪唑（C对）。硫脲类抗甲状腺药中甲巯咪唑作用较丙硫氧嘧啶（B错）强，且奏效快而代谢慢，维持时间较长，而卡比马唑（A错）是在体内逐渐水解，游离出甲巯咪唑而发挥作用，起效比较缓慢。碳酸锂（D错）为抗躁狂药，主要用于治疗躁狂症，对躁狂和抑郁交替发作的双相情感性精神障碍有很好的治疗和预防复发的作用，对反复发作的抑郁症也有预防发作的作用。复方碘溶液（E错）为甲状腺激素合成的原料，用以预防和治疗地方性甲状腺肿。用于甲状腺功能亢进术前准备，使甲状腺变小变硬，血流减少。抑制甲状腺激素释放，治疗甲状腺危象。